影响修复体与牙本质粘接的原因是以下哪一项
A. 粘接材料的原因
B. 牙本质液的形成
C. 牙本质小管的结构松散
D. 封闭了牙本质小管
E. 牙本质湿性黏结

正确答案：B。牙本质液的形成

解析：本题考查牙本质。牙本质液的形成（B对）会影响牙本质与修复材料的结合。